初产妇，26岁。妊娠39周，估计胎儿体重3600g，坐骨结节间径7cm，出口后矢状径6.5cm。正确的处理措施应为
A. 产钳术
B. 剖宫产术
C. 等待自然分娩
D. 静脉滴注缩宫素
E. 会阴切开分娩

正确答案：B。剖宫产术

解析：初产妇，26岁。妊娠39周（妊娠满37周至不满42足周期间分娩，为足月产），估计胎儿体重3600g（＜4000g，不属于巨大胎儿），坐骨结节间径7cm（正常值8.5～9.5㎝），出口后矢状径6.5cm（正常值8～9㎝），此患者坐骨结节间径和出口后矢状径均小于正常值（骨盆出口平面狭窄以坐骨结节间径及骨盆出口后矢状径狭窄为主），符合骨盆出口平面狭窄的诊断，对于骨盆出口平面狭窄的处理，临床常用坐骨结节间径与出口后矢状径之和估计出口大小，此患者两者之和为13.5cm（≤15cm），足月胎儿不易经阴道分娩，应尽快行剖宫产术（B对）。只有坐骨结节间径与出口后矢状径之和＞15㎝时，才可经阴道分娩，故不考虑产钳术（A错）、等待自然分娩（C错）、会阴切开分娩（E错）（P195）。静脉滴注缩宫素（D错）为阴道分娩的辅助方式，也不考虑。